对于膝关节骨关节炎的叙述，正确的是
A. 负重较少
B. 尽早行人工关节表面置换术
C. 晚期可出现关节畸形
D. 膝内翻时可行软组织松解
E. 主要病变是关节滑膜的退行性变

正确答案：C。晚期可出现关节畸形

解析：骨关节炎是一种以关节软骨退行性变和继发性骨质增生为特征的慢性关节疾病，故膝关节骨关节炎主要病变是关节软骨的退行性变（E错）。骨关节炎好发于负重较大的膝关节（A错）、髋关节、脊柱及远侧指间关节等部位。膝关节骨关节炎晚期可出现膝内翻畸形（C对），此时关节面已有严重破坏畸形，故行软组织松解（D错）不能改善内翻畸形。膝关节骨关节炎患者早期可采用理疗、药物等非手术治疗，而非尽早行人工关节表面置换术（B错）。